上颌结节阻滞麻醉，如针头污染可引起的间隙感染是
A. 咬肌间隙感染
B. 眶下间隙感染
C. 下颌下间隙感染
D. 翼下颌间隙感染
E. 颞下间隙感染

正确答案：E。颞下间隙感染

解析：颞下间隙感染来源可从相邻间隙，如翼下颌间隙等感染扩散而来；也可因上颌结节、卵圆孔、圆孔阻滞麻醉时带入感染；或由上颌磨牙的根尖周感染或拔牙后感染引起。掌握“翼下颌间隙、颞下间隙感染”知识点。